分子中含有苯并二氮䓬结构的药物是
A. 唑吡坦
B. 硫喷妥钠
C. 硝西泮
D. 氟西汀
E. 舒必利

正确答案：C。硝西泮

解析：本题考查苯二氮䓬类药物硝西泮。分子中含有苯并二氮䓬结构的药物是硝西泮（C对）。硝西泮为苯并二氮䓬结构的镇静催眠药物，其基本结构药物为地西泮，在地西泮A环的7位上引入了吸电子的硝基而得。唑吡坦（A错）为非苯二氮䓬结构的镇静催眠药，分子中含有咪唑并吡啶结构，不含苯并二氮䓬结构。硫喷妥钠（B错）为巴比妥类即环丙二酰脲结构的药物，其中2位O原子被S原子取代，脂溶性增加，不含苯并二氮䓬结构。氟西汀（D错）为非三环类抗抑郁药，分子中不含苯并二氮䓬结构。舒必利（E错）属于非典型抗精神病药，为苯磺酰胺结构，不含苯并二氮䓬结构。